亚慢性毒性试验的一般性指标有
A. 特殊基团检测
B. 特殊基因测试
C. 灵敏指标的检查
D. 动物死亡率
E. 脏器系数

正确答案：E。脏器系数